抑制性中枢神经递质是指:
A. 亮氨酸、异亮氨酸和缬氨酸
B. 苯丙氨酸、酪氨酸和色氨酸
C. GABA和谷氨酰胺
D. 乙酰胆碱和谷氨酸
E. 苯乙醇胺、羟乙醇胺和5-羟色胺

正确答案：C。GABA和谷氨酰胺

解析：抑制性中枢神经递质是指GABA和谷氨酰胺（C对）。